某药肝脏首过作用较大，可选用适宜的剂型是
A. 肠溶片剂
B. 舌下片剂
C. 口服乳剂
D. 透皮给药系统
E. 气雾剂

正确答案：B、D、E。舌下片剂；透皮给药系统；气雾剂

解析：本题考查首过效应。某药肝脏首过作用较大，可选用适宜的剂型是舌下片剂（B对）、透皮给药系统（D对）、气雾剂（E对）。首过效应是指口服药物在未吸收进入血循环之前被代谢，而使进入血循环的原形药量减少的现象；肠溶片（A错）与口服溶液（C错）均属于口服给药制剂，易产生较大的首过效应。